若一侧动眼神经损伤，该损伤侧瞳孔
A. 直接、间接对光反射均消失
B. 直接、间接对光反射均存在
C. 直接对光反射存在，间接对光反射消失
D. 直接对光反射消失，间接对光反射存在
E. 直接对光反射消失，间接对光反射视不同情况而定

正确答案：A。直接、间接对光反射均消失

解析：一侧动眼神经损伤，该损伤侧瞳孔直接、间接对光反射均消失（A对），并伴上脸下垂、瞳孔斜向外下方及瞳孔扩大。